子宫颈癌的主要发病因素是
A. HPV
B. 单纯疱疹病毒
C. 巨细胞病毒
D. 衣原体
E. 梅毒螺旋体

正确答案：A。HPV

解析：子宫颈癌的主要发病因素是HPV感染（A对），约99%的子宫颈癌患者有高危型HPV感染。